属于第Ⅱ相生物转化的反应有
A. 对乙酰氨基酚和葡萄糖醛酸的结合反应
B. 沙丁胺醇和硫酸的结合反应
C. 白消安和谷胱甘肽的结合反应
D. 对氨基水杨酸的乙酰化结合反应
E. 肾上腺素的甲基化结合反应

正确答案：A、B、C、D、E。对乙酰氨基酚和葡萄糖醛酸的结合反应；沙丁胺醇和硫酸的结合反应；白消安和谷胱甘肽的结合反应；对氨基水杨酸的乙酰化结合反应；肾上腺素的甲基化结合反应

解析：本题考查药物化学结构与第Ⅱ相生物转化的规律。第Ⅱ相生物转化最普遍的反应包括：1.与葡萄糖醛酸的结合反应、2.与硫酸的结合反应、3.与氨基酸的结合反应、4.与谷胱甘肽的结合反应、5.乙酰化结合反应、6.甲基化结合反应。对乙酰氨基酚和葡萄糖醛酸的结合反应（A对）属于与葡萄糖醛酸的结合反应；沙丁胺醇结构中的酚羟基与硫酸结合成硫酸酯化结合物，属于与硫酸的结合反应（B对）；白消安与谷胱甘肽的结合（C对）属于与谷胱甘肽的结合反应；对氨基水杨酸的乙酰化反应（D对）属于乙酰化结合反应；肾上腺素的甲基化结合反应（E对）属于甲基化结合反应。